《素问·五藏生成篇》说：“多食辛”，则
A. 肉胝陷而唇揭
B. 筋急而爪枯
C. 骨痛而发落
D. 脉凝泣而变色
E. 皮槁而毛拔

正确答案：B。筋急而爪枯

解析：《素问·五藏生成》说：多食咸，则脉凝泣而变色（D错）；多食苦，则皮槁而毛拔（E错）；多食辛，则筋急而爪枯（B对）；多食酸，则肉胝皱而唇揭（A错）；多食甘，则骨痛而发落（C错）。